引起牙髓活力电测验假阴性反应原因不包括
A. 测试前使用过麻醉剂
B. 根尖尚未发育完全的新萌出的牙
C. 做过干髓术的牙
D. 根管内过度钙化的牙
E. 刚受过外伤的牙

正确答案：C。做过干髓术的牙

解析：本题考查引起牙髓活力电测验假阴性反应的原因。做过干髓术的牙，牙髓活力已丧失，测出的结果为牙髓的真实失活状态（C错，为本题的正确答案）。牙髓活力电测验是通过牙髓电活力测验仪来检测牙髓神经成分对电刺激的反应，主要用于判断牙髓“生”或“死”的状态。其方法是将探头放在牙唇颊面中1/3处，调节测验仪上的电流强度得出牙髓活力的有无。出现假阴性的原因有：测试前使用过麻醉剂（A对），牙髓麻醉不能正常地感知电流；根尖尚未发育完全的新萌出的牙（B对），由于根尖孔未闭合不能与测试仪形成闭合通路，导致牙髓对电刺激无反应；根管内过度钙化的牙，其牙髓对电刺激通常无反应（D对）；刚受过外伤的牙，牙髓处于休克期，牙髓对电刺激无反应（E对）。